冠心病临床分型不包括
A. 心绞痛
B. 心肌梗死
C. 缺血性心肌病
D. 猝死
E. 心肌炎

正确答案：E。心肌炎

解析：冠心病临床上分为：隐匿型或无症状型冠心病、心绞痛、心肌梗死、缺血性心肌病、猝死五种。掌握“冠状动脉粥样硬化性心脏病”知识点。